医院获得性肺炎中，病原体进入肺组织引发肺炎最主要感染途径是
A. 飞沫（气溶胶）吸入
B. 血源性播散
C. 接触传播
D. 口咽部分泌物吸入
E. 污染空气吸入

正确答案：D。口咽部分泌物吸入

解析：医院获得性肺炎中，病原体进入肺组织引发肺炎最主要感染途径是通过误吸胃肠道的定植菌（胃食管反流），即口咽部分泌物吸入（D对），和（或）通过人工气道吸入环境中的致病菌引起。